某女，18岁，半年前失恋后精神抑郁，时喃喃自语，哭笑无常，痰多胸闷，舌苔白腻，脉弦滑。临床诊断最可能是
A. 痰迷心窍证
B. 肝气郁结证
C. 心火亢盛证
D. 痰火扰心证
E. 胆郁痰扰证

正确答案：A。痰迷心窍证

解析：痰蒙心神，又称痰迷心窍，是痰浊蒙闭心窍表现的证候。精神抑郁，时喃喃自语，哭笑无常，均多因情志不遂，肝失疏泄，气郁痰生，痰气互结，蒙蔽神明，不能自主所致；胸闷泛恶多因痰阻胸阳，胃失和降所致；舌苔白腻，脉滑，均多因痰浊内盛所致。故为痰迷心窍（A对）。